幼儿急疹的临床特点是
A. 发热1～2天出疹
B. 热退后全身出疹
C. 出疹时全身体温升高
D. 皮疹常有融合
E. 疹退后皮肤留有棕色色素沉着

正确答案：B。热退后全身出疹

解析：幼儿急疹由人疱疹病毒6型感染引起。高热3-5天，热退后全身出疹（B对）。皮疹特点为红色系小密集斑丘疹，头面颈及躯干部多见，四肢较少，一天出齐，次日开始消退。发热1～2天出疹（A错）多见于风疹。出疹时全身体温升高（C错）多见于麻疹。皮疹常有融合（D错）可见于重症水痘（P174）。疹退后皮肤留有棕色色素沉着（E错）常见于麻疹。